吕某，男，5岁，左上后牙反复疼痛肿胀半年，未经系统专科治疗。检查：左上Ⅴ残冠，探不痛，叩（+），冷测无反应，松（++），颊侧瘘管溢脓左上6未萌出。X线示左上Ⅴ根周暗影牙根吸收约1/3，左上6已萌至龈下，牙根形成约2/3。治疗措施最好采用
A. 根管治疗+嵌体修复
B. 根管治疗+金属成品冠修复
C. 拔牙+丝圈式间隙保持器
D. 拔牙+远中导板间隙保持器
E. 姑息疗法，髓腔换药

正确答案：D。拔牙+远中导板间隙保持器

解析：本题考查远中导板间隙保持器的适应症。上后牙反复疼痛肿胀半年，颊侧瘘管溢脓左上6未萌出，左上Ⅴ残冠，探不痛，叩（+），冷测无反应，诊断为乳牙慢性根尖周炎。左上6已萌至龈下，牙根形成约2/3为NollaⅧ期，牙齿应临床萌出且上Ⅴ根周暗影牙根吸收约1/3，有炎症性病变影响恒牙萌出，松（++），所以建议拔除左上Ⅴ（ABE错）。第一恒磨牙正在萌出，根据远中导板间隙保持器的适应症，因此应选用远中导板间隙保持器（D对C错）。